对硫磷农药体内转化、经氧化作用可以使产物
A. 毒性增强
B. 毒性降低
C. 毒性不变
D. 物理性状改变
E. 作用器官改变

正确答案：A。毒性增强